通过拮抗多巴胺D₂受体，增加乙酰胆碱释放，同时又能抑制乙酰胆碱酯酶活性，减少乙酰胆碱分解，从而增强胃收缩力，加速胃排空的药物是
A. 多潘立酮
B. 伊托必利
C. 莫沙必利
D. 甲氧氯普胺
E. 雷尼替丁

正确答案：B。伊托必利

解析：本题考查伊托必利。伊托必利（B对）具有阻断多巴胺D₂受体活性和抑制乙酰胆碱酯酶活性的双重活性，通过对D₂受体的拮抗作用而增加乙酰胆碱的释放，同时通过对乙酰胆碱酯酶的抑制作用来抑制已释放的乙酰胆碱分解，从而增强胃、十二指肠收缩力，加速胃排空，并有止吐作用。甲氧氯普胺（D错）为多巴胺D₂受体阻断药，同时还具有5-HT₄受体激动效应，对5-HT₄受体有轻度抑制作用，具有促动力作用和止吐的作用。多潘立酮（A错）为较强的外周性多巴胺D₂受体阻断药，故较少出现甲氧氯普胺的中枢神经系统的副作用（锥体外系症状）。莫沙必利（C错）为新型促胃肠动力药，是强效、选择性5-HT₄受体激动药。雷尼替丁（E错）是H₂受体阻断剂抗溃疡药，临床用于治疗胃、十二指肠溃疡，消化道出血、胃炎、反流性食管炎及卓-艾综合征。